女性，52岁，有胆管结石病史，近2天来右上腹疼痛，体温37.8度，2小时前突然畏寒、寒战，体温达40℃，精神紧张兴奋，口渴，面色苍白，脉搏98次/分，有力，血压110/96mmHg，尿量26ml。下列哪项治疗原则是错误的
A. 积极补充血容量
B. 联合应用抗菌药物
C. 尽早做胆管引流
D. 纠正酸中毒
E. 静脉滴注间羟胺

正确答案：E。静脉滴注间羟胺

解析：患者胆管结石史，近日右上腹疼痛，突发畏寒、寒战、高热（39.1～41℃为高热），提示出现胆源性感染；精神紧张兴奋、口渴、面色苍白提示出现感染性休克。感染性休克的治疗首先是病因治疗，原则是在休克未纠正以前，应着重治疗休克，同时治疗感染；在休克纠正后，则应着重治疗感染。积极补充血容量（A对）、联合应用抗菌药物（B对）、尽早做胆管引流（C对）、纠正酸中毒（D对）均为感染性休克的治疗措施。其中做胆管引流为病因治疗，因为该患者的休克是由于胆源性感染引起的，只有使胆道压力降低，才有可能中止胆汁或细菌向血液的反流，阻断病情的恶化。间羟胺为血管收缩剂，作用是兴奋心肌、收缩血管、升高血压，但其应在补充血容量、纠正酸中毒而休克未见好转时，联合血管舒张剂一同应用，单独应用容易加重组织缺血、引发微循环瘀滞（E错，为本题正确答案）。